Th1细胞的效应增强CTL和NK细胞的活性是Th1细胞通过产生
A. IL-1和IFN-γ
B. IL-2和IFN-γ
C. IL-3和IFN-γ
D. IL-4和IFN-γ
E. IL-5和IFN-γ

正确答案：B。IL-2和IFN-γ

解析：Th1细胞的效应：Th1细胞通过产生IL-2和IFN-γ等细胞因子增强CTL和NK细胞的活性，使其更高效杀伤病毒感染细胞或肿瘤细胞。掌握“B细胞、T细胞介导的免疫应答”知识点。